C1抑制物缺乏会导致
A. 原发性B细胞缺陷
B. 重症联合免疫缺陷
C. 原发性补体缺陷
D. 遗传性血管神经性水肿
E. 多发性骨髓瘤

正确答案：D。遗传性血管神经性水肿